劳淋治疗应首选的方剂是
A. 无比山药丸
B. 八珍汤
C. 河车大造丸
D. 金匮肾气丸
E. 附子理中丸

正确答案：A。无比山药丸

解析：无比山药丸中党参、黄芪、山药、莲子肉补气健脾；茯苓、薏苡仁、泽泻、扁豆衣化湿利水；山茱萸、菟丝子、芡实 金樱子、煅牡蛎益肾固摄。健脾益肾，用于久淋造成脾肾两虚的劳淋（A对）。八珍汤气血双补（B错）；河车大造丸滋阴填精，养肺肾（C错）；金匮肾气丸补肾阳（D错）；附子理中丸治脾肾阳虚（E错）。